斑蝥除能破血散结外，又能
A. 攻毒蚀疮
B. 开窍醒神
C. 通络散结
D. 收湿生肌
E. 劫痰平喘

正确答案：A。攻毒蚀疮

解析：本题考查的是斑蝥的功效。斑蝥除能破血散结外，又能攻毒蚀疮（A对）。斑蝥：【功效】攻毒蚀疮，破血逐瘀，散结消癥。蟾酥：【功效】解毒消肿，止痛，开窍醒神（B错）。马钱子：【功效】散结消肿，通络止痛（C错）。炉甘石：【功效】明目去翳，收湿生肌（D错）。砒石：【功效】外用蚀疮去腐；内服劫痰平喘（E错），截疟。